功利论是指
A. 关于责任应当的理论
B. 以人们行为的效果作为道德价值基础
C. 考虑个别主体利益需求
D. 主张医护人员遵守既定的原则规范
E. 以人们的动机为道德价值基础

正确答案：B。以人们行为的效果作为道德价值基础

解析：功利论是以道德行为后果作为确定道德规范与评价道德行为对错与否的最终依据的伦理学理论（B对）。